疾病的概念下列哪项提法较正确
A. 是机体在一定病因损害下，因自稳调节紊乱而发生的异常生命活动
B. 疾病即指机体不舒服
C. 疾病是机体对内环境的协调障碍
D. 疾病是不健康的生命活动过程
E. 细胞是生命的基本单位，疾病是细胞受损的表现

正确答案：A。是机体在一定病因损害下，因自稳调节紊乱而发生的异常生命活动

解析：疾病是机体在一定病因损害下，因自稳调节紊乱而发生的异常生命活动（A对）。机体不舒服（B错）可能发生在心理疾病的过程中。